下列对阻生智齿的命名中哪一项是错误的
A. 近中垂直阻生
B. 水平阻生
C. 远中阻生
D. 倒置阻生
E. 舌向阻生

正确答案：A。近中垂直阻生

解析：本题考查阻生智齿的命名。近中阻生与垂直阻生是并列关系，不存在近中垂直阻生（A错，为本题的正确答案）。关于阻生智齿的命名临床分类方法很多，其中Winter根据阻生智牙的长轴与第二磨牙长轴的关系，将阻生智牙命名为以下7种：垂直阻生；水平阻生（B对）；近中阻生；远中阻生（C对）；颊向阻生；舌向阻生（E对）；倒置阻生（D对）。